A和B两种抛射剂的蒸汽压分别为12.5和22.3，两者等量混合的蒸汽压是
A. 11
B. 17.4
C. 34.8
D. 58.2
E. 69.6

正确答案：C。34.8

解析：本题考查抛射剂蒸气压的计算。混合抛射剂的蒸汽压可根据拉乌尔定律计算，系统的总蒸汽压等于系统中不同组分分压之和，P=Pa+Pb，混合后的蒸汽压=12.5+22.3=34.8（C对）。